牙拔除后需要多长时间，X线片上拔牙创出现正常的骨结构
A. 半个月后
B. 1～2个月
C. 2～3个月
D. 3～6个月
E. 6～12个月

正确答案：D。3～6个月

解析：牙槽突功能性改建术后3天就开始了。40天后愈合区内逐渐形成多层骨小梁一致的成熟骨，并有一层密质骨覆盖这一区域。牙槽骨受到功能性压力后，骨小梁的数目和排列顺应变化而重新改造。3～6个月后重建过程基本完成，出现正常骨结构。掌握“牙拔除术前准备、器械、心血管及拔牙愈合过程”知识点。